含磺酰胺基的抗痛风药是
A. 舒林酸
B. 吡罗昔康
C. 别嘌醇
D. 丙磺舒
E. 秋水仙碱

正确答案：D。丙磺舒

解析：本题考查丙磺舒。含磺酰胺基的抗痛风药是丙磺舒（D对）。丙磺舒分子中含有磺酰胺基，竞争性抑制肾小管对有机酸的转运，抑制肾小管对尿酸的重吸收，增加尿酸排泄，可用于治疗慢性痛风。舒林酸（A错）、别嘌醇（C错）、秋水仙碱（E错）分子中均不含有磺酰胺基。吡罗昔康（B错）为非羧酸类抗炎药，分子中含有磺酰胺基，用于治疗风湿性关节炎及类风湿关节炎，不用于痛风治疗。